骨下袋系根据下列情况分类
A. 累及的牙面数
B. 骨质破坏程度
C. 残留的骨壁数
D. 牙周袋底与牙槽嵴顶的关系
E. 牙周袋的深度

正确答案：D。牙周袋底与牙槽嵴顶的关系

解析：本题考查牙周袋的类型。根据牙周袋底与牙槽嵴顶的关系（D对），将牙周袋分为骨上袋和骨下袋。按其累及牙面的情况（A错）分为：单面袋，复合袋和复杂带。骨下袋根据骨质破坏后剩余的骨壁数目（C错）分为一壁骨袋，二壁骨袋，三壁骨袋，四壁骨袋，混合壁袋；骨质破坏程度（B错）和牙周袋深度（E错）是用来判断牙周炎严重程度的指标。